利尿脱水急速降低体重的兴奋剂
A. 呋塞米
B. 甲睾酮
C. 哌替啶
D. 苯丙胺
E. 哌唑嗪

正确答案：A。呋塞米

解析：本题考查兴奋剂的分类。呋塞米（A对）为兴奋剂中的利尿药。有的人滥用此类药物的目的：①通过快速排除体内水分，减轻体重。②增加尿量以尽快减少体液和排泄物中其他兴奋剂代谢产物，以此来造成药检的假阴性结果。③加速其他兴奋剂及其他代谢产物的排泄过程，从而缓解某些副作用。甲睾酮（B错）为蛋白同化制剂（合成类固醇）。哌替啶（C错）为麻醉止痛剂。苯丙胺（D错）为精神刺激药。哌唑嗪（E错）不属于兴奋剂。